根据《关于改革完善仿制药供应保障及使用政策意见》，关于改革与完善仿制药供应保障配套支持政策的说法，错误的是
A. 药品集中采购机构按药品通用名编制采购目录，及时将符合条件的仿制药纳入采购范围
B. 加快制定医保药品支付标准，与原研药质量和疗效一致的仿制药支付标准应当适当高于原研药
C. 将与原研药质量和疗效一致的仿制药纳入可相互替代的药品目录，并在药品说明书、标签中予以标注，便于医务人员和患者选择使用
D. 落实税收优惠和价格政策，鼓励地方结合实际出台支持仿制药转型升级的政策措施

正确答案：B。加快制定医保药品支付标准，与原研药质量和疗效一致的仿制药支付标准应当适当高于原研药

解析：本题考查的是药品使用政策与改革措施。加快制定医保药品支付标准，与原研药质量和疗效一致的仿制药、原研药按相同标准支付（B错，为本题正确答案）。药品使用政策与改革措施：使用环节改革强调调整利益驱动机制，规范医疗和用药行为。一是促进合理用药。公立医院要优先使用国家基本药物，强化药物使用监管。二是进一步破除以药补医机制。坚持医疗、医保、医药联动，统筹推进取消药品加成、调整医疗服务价格、鼓励到零售药店购药等改革，落实政府投入责任，加快建立公立医院补偿新机制。推进医药分开。医疗机构应按药品通用名开具处方，并主动向患者提供处方。门诊患者可以自主选择在医疗机构或零售药店购药，医疗机构不得限制门诊患者凭处方到零售药店购药。三是强化医保规范行为和控制费用的作用。充分发挥各类医疗保险对医疗服务行为、医药费用的控制和监督制约作用，逐步将医保对医疗机构的监管延伸到对医务人员医疗服务行为的监管。四是积极发挥药师作用。落实药师权利和责任，充分发挥药师在合理用药方面的作用。在使用环节，改革完善仿制药供应保障及使用机制，对提高药品供应保障能力，降低医疗支出，提高药品可及性，提升医疗服务水平等都具有重要经济和社会效益。根据国务院办公厅印发《关于改革完善仿制药供应保障及使用政策的意见》（国办发〔2018〕20号），通过在仿制药研发、提升质量疗效和完善支持政策三方面采取有效措施，旨在提高药品供应保障能力，更好地满足临床用药及公共卫生安全需求，加快我国由制药大国向制药强国跨越。在完善配套支持政策方面，一是药品集中采购机构要按药品通用名编制采购目录，及时将符合条件的仿制药纳入采购目录范围，并及时启动采购程序（A对）；二是将与原研药质量和疗效一致的仿制药纳入与原研药可相互替代的药品目录，在说明书、标签中予以标注，便于医务人员和患者选择使用（C对）；三是加快制定医保药品支付标准，与原研药质量和疗效一致的仿制药、原研药按相同标准支付。建立完善基本医疗保险药品目录动态调整机制，及时将符合条件的药品纳入目录。通过医保支付激励约束机制，鼓励医疗机构使用仿制药。在药品生产政策与改革措施方面，应落实税收优惠和价格政策，鼓励地方结合实际出台支持仿制药转型升级的政策措施，加大扶持力度（D对）。